恶性程度最高的乳癌类型是
A. 浸润性导管癌
B. 浸润性小叶癌
C. 湿疹样癌
D. 炎性乳癌
E. 髓样癌

正确答案：D。炎性乳癌

解析：恶性程度最高的乳癌类型是炎性乳癌（D对），常表现为皮肤红肿、局部温度增高、水肿、肿块边界不清，常有腋淋巴结转移，该型肿瘤生长快，预后极差。